机体感染病原体后，导致体内细胞因子迅速大量产生，这种现象称为
A. 细胞因子异常
B. 细胞因子风暴
C. 补体异常
D. 细胞因子检测
E. 适应性免疫

正确答案：B。细胞因子风暴

解析：细胞因子风暴也称高细胞因子血症，表现为短期内机体大量分泌多种细胞因子，引发全身炎症反应综合征，严重者可导致多器官功能障碍综合征（B对）。